应提出“建议不宜生育”的情况是
A. 软骨发育不全
B. 一方或双方患有重度、极重度智力低下神经衰弱
C. 细菌性阴道病
D. 艾滋病病毒携带者
E. 梅毒活动期

正确答案：A。软骨发育不全

解析：本题考查医学意见的相关内容。“建议不宜生育”的情况为：患有严重遗传性疾病或其他重要脏器疾病，如进行性肌营养不良、马凡氏综合征、软骨发育不全（A对BCDE错）、成骨不全、视网膜色素变性等。